患者，男，78岁，全身皮肤瘙痒，以夜间为甚；查体：皮肤较干燥，躯干四肢抓痕累累，伴头晕眼花，失眠多梦，舌淡，苔薄白，脉细。治法宜选用
A. 疏风清热凉血
B. 清热利湿止痒
C. 凉血清热润燥
D. 养血润燥祛风
E. 活血化瘀祛风

正确答案：D。养血润燥祛风

解析：患者，男，78岁，全身皮肤瘙痒，以夜间为甚查，诊断为瘙痒症，血虚风燥证，风邪侵袭肌肤，营卫不和，故见皮肤较干燥，躯干四肢抓痕累累；血虚不能濡养头目故见头晕眼花；血虚心神失养故见失眠多梦，舌淡苔薄白，脉细（D对）。患者无面红目赤，发热等热证，无需清热（A错）。患者无疱疹、渗液、糜烂等湿邪侵袭表现，无需利湿（B错）。患者无皮肤灼热，红肿痒痛等血热表现，无需凉血（C错）。患者无皮肤紫暗、舌有瘀斑等血瘀证，无需活血（E错）。